慢性非特异性唇炎的病因包括
A. 舔唇不良习惯
B. 机械性长期刺激
C. 寒冷干燥
D. 精神因素
E. 以上都是

正确答案：E。以上都是

解析：本题考查慢性非特异性唇炎。慢性非特异性唇炎又称慢性唇炎，不能归入后述各种有特殊病理变化或病因的唇炎，病程迁延，反复发作。其病因不明，一般无全身性疾病。可能与某些温度、化学、机械性长期持续刺激因素（B对）有关。例如嗜好烟酒、烫食；舔唇咬唇不良习惯（A对）。多见于高原寒冷地区或气候干燥季节（C对）；与精神因素（D对）有关。因此选E。